下列哪项不属于天疱疮的临床分型
A. 落叶型天疱疮
B. 寻常型天疱疮
C. 颗粒型天疱疮
D. 增殖型天疱疮
E. 红斑型天疱疮

正确答案：C。颗粒型天疱疮

解析：天疱疮可分为四型：寻常型、增殖型、落叶型和红斑型天疱疮。掌握“天疱疮”知识点。